脂质体的制备方法不包括
A. 注入法
B. 薄膜分散法
C. 超声波分散法
D. 复凝聚法
E. 逆向蒸发法

正确答案：D。复凝聚法

解析：本题考查脂质体的制备方法。脂质体的制备方法不包括复凝聚法（D错，为本题正确答案）。复凝聚法是微囊的制备方法。脂质体的制备方法有注入法（A对）、薄膜分散法（B对）、超声波分散法（C对）、逆向蒸发法（E对）、冷冻干燥法。